张某在接种某疫苗后发生残疾，经查该疫苗质量合格，接种过程符合规范，张某依法获得赔偿，赔偿他的机构是
A. 省级医疗管理部门
B. 为其接种的工作人员
C. 为其接种的机构
D. 疫苗上市许可持有人
E. 省级财政部门

正确答案：E。省级财政部门

解析：《疫苗流通和预防接种管理条例》规定，省、自治区、直辖市人民政府财政部门在预防接种工作经费中安排适用于因预防接种异常反应引起受种者死亡、严重残疾或者器官组织损伤的应当给予一次性补偿。因接种第一类疫苗引起预防接种异常反应需要对受种者予以补偿的情况（E对ABCD错）。